经产妇，31岁。现妊娠35周。查体：BP120/80mmHg，宫底35cm，胎心136次/分。空腹血糖6.2mmol/L，尿糖（+）。2年前因妊娠8个月死胎行引产术。对该产妇分娩的新生儿，不必要的处理是
A. 检测血糖值
B. 按早产儿护理
C. 检测血钙值
D. 定时滴服葡萄糖液
E. 加压吸氧

正确答案：E。加压吸氧

解析：早产是指妊娠满28周至不足37周分娩者，该产妇妊娠35周，分娩的新生儿属于早产儿，故不答A。妊娠合并糖尿病产妇所生新生儿出生时应留脐血，测定血糖、 胰岛素、胆红素、钙、磷、镁；注意保暖和吸氧；重点防止新生儿低血糖，应在开奶同时，定期滴服葡萄糖液。 早产儿加压吸氧易导致视网膜病变，故答 E。